川崎病发病早期10天以内宜给予何种药物来迅速退热和预防冠状动脉病变的发生
A. 阿司匹林
B. 糖皮质激素
C. 抗生素
D. 注射丙种球蛋白
E. 肝素

正确答案：D。注射丙种球蛋白

解析：静注丙种球蛋白（IVIG）2g/kg，8～12h内静脉滴入，宜于发病早期（10天以内）应用，可迅速退热，预防冠状动脉病变发生。掌握“川崎病”知识点。